体育课期间的平均脉搏应维持在
A. 80～130次/分
B. 90～120次/分
C. 130～170次/分
D. 130～180次/分
E. 140～200次/分

正确答案：C。130～170次/分